急性普通型病毒性肝炎，其坏死病变主要为
A. 点状坏死
B. 桥接坏死
C. 碎片状坏死
D. 大片坏死
E. 灶性坏死

正确答案：A。点状坏死

解析：急性普通型病毒性肝炎的病变轻微，肝细胞常见点状坏死（A对）。桥接坏死（B错）常见于中度和重度慢性肝炎。碎片状坏死（灶性坏死）常见于慢性肝炎（CE错）。大片坏死（D错）常见于重型肝炎。